不符合药品经营企业零售药品要求的情形有
A. 按商品的品种规格、剂型或用途分类陈列于橱窗与货柜
B. 陈列药品时，应做到药品与非药品分开，人用药与兽用药分开
C. 建立卫生制度，保证药品不受污染
D. 坚持问病卖药，防止事故发生
E. 麻醉药品、一类精神药品和毒性药品置专门的橱窗陈列

正确答案：E。麻醉药品、一类精神药品和毒性药品置专门的橱窗陈列

解析：本题考查药品经营企业零售药品要求的情形。不符合药品经营企业零售药品要求的情形有麻醉药品、一类精神药品和毒性药品置专门的橱窗陈列（E对）。《麻醉药品与精神药品管理条例》第三十条规定，麻醉药品和第一类精神药品不得零售。按商品的品种规格、剂型或用途分类陈列于橱窗与货柜（A对），陈列药品时，应做到药品与非药品分开，人用药与兽用药分开（B对），建立卫生制度，保证药品不受污染（C对），坚持问病卖药，防止事故发生（对）均符合药品经营企业零售药品要求的情形。